吸收后代谢成活性产物而发挥抗甲型和乙型流感病毒的前体药物是
A. 金刚烷胺
B. 金刚乙胺
C. 扎那米韦
D. 奥司他韦
E. 阿昔洛韦

正确答案：D。奥司他韦

解析：本题考查奥司他韦。吸收后代谢成活性产物而发挥抗甲型和乙型流感病毒的前体药物是奥司他韦（D对）。奥司他韦是其活性代谢产物的药物前体，其活性代谢产物（奥司他韦羧酸盐）是选择性的流感病毒神经氨酸酶抑制剂。奥司他韦羧酸盐能够抑制甲型和乙型流感病毒的神经氨酸酶活性，药物通过抑制病毒从被感染的细胞中释放、复制，从而减少了甲型或乙型流感病毒的播散，从而起抗病毒作用。金刚烷胺（A错）是最早用于抑制流感病毒的抗病毒药，美国于亚洲感冒流行的1966年批准其作为预防药。金刚乙胺（B错）原料药被列为流感防治国家储备药品。金刚乙胺可抑制流感病毒株的复制，是预防流感和进行流感早期治疗的优势药物。扎那米韦（C错）用于治疗A型和B型流感，该品通过抑制流感病毒的神经氨酸酶，从而改变了流感病毒在感染细胞内的聚集和释放。阿昔洛韦（E错）为一种合成的嘌呤核苷类似物为抗病毒药，用于生殖器疱疹病毒感染初发和复发单纯疱疹病毒感染病例，对反复发作病例口服本品用作预防。